酵解过程中可被别构调节的限速酶是
A. 3-磷酸甘油醛脱氢酶
B. 6-磷酸果糖激酶
C. 乳酸脱氢酶
D. 醛缩酶
E. 磷酸己糖异构酶

正确答案：B。6-磷酸果糖激酶